有关低血糖症的论述中，正确的是
A. 口服α糖苷抑制剂易发生低血糖
B. 低血糖可伴有精神症状
C. 2型糖尿病患者不表现为低血糖
D. 胰岛素瘤较少出现空腹低血糖
E. 腺垂体功能减退低血糖时血胰岛素升高

正确答案：B。低血糖可伴有精神症状

解析：低血糖症是一组多种病因引起的以静脉血浆葡萄糖（简称血糖）浓度过低，临床上以交感神经兴奋和脑细胞缺糖为主要特点的综合征。大脑缺乏足量葡萄糖供应时，可出现幻觉、躁动、易怒、行为怪异等精神症状（B对）。口服α葡萄糖苷抑制剂（A错）通过抑制α-葡萄糖苷酶延缓碳水化合物的吸收，降低餐后高血糖，单用此药不引起低血糖（P739）。2型糖尿病部分患者早期餐后3～5小时血浆胰岛素水平不适当地升高，可引起低血糖（P729），但多数患者表现为血糖升高（C错）。胰岛素瘤可大量分泌胰岛素而出现空腹低血糖（D错）。腺垂体功能减退主要表现为各靶腺功能减退，故低血糖为升糖激素降低导致，其血胰岛素分泌仍减少（E错）。